女，外伤后失血，血压80/56mmHg，脉率130次/分，估计失血量达
A. 400～600ml
B. 650～750ml
C. 800～1600ml
D. 1650～2000ml
E. ＞2000ml

正确答案：C。800～1600ml

解析：患者有明确的外伤后出血病史，收缩压80mmHg，脉率130次/分，属于中度休克，这个时期的估计失血量为全身血量的20%～40%，即800～1600ml（C对）。出血在800ml以下（AB错）时应处于休克代偿期，此时患者脉搏为100次/分以下，收缩压正常或稍高。出血量＞1600ml（DE错）时应为重度休克，患者脉搏细速或摸不到，收缩压在70mmHg以下或测不到。